按寸口脉分候脏腑，右关脉可候
A. 心与膻中
B. 肾与小腹
C. 脾与胃
D. 肝、胆与膈
E. 肺与胸中

正确答案：C。脾与胃

解析：右关脉可候脾与胃（C对）。心与膻中为左寸脉所候（A错）。肾与小腹为尺脉所候（B错）。肝、胆与膈为左关脉所候（D错）。肺与胸中为右寸脉所候（E错）。